第一个人体试验的伦理文献
A. 《纽伦堡法典》
B. 《道德与文明》
C. 希波克拉底誓言
D. 日内瓦宣言
E. 荷兰会议

正确答案：A。《纽伦堡法典》

解析：早在1946年，在德国纽伦堡对纳粹医生进行审判的基础上，制订、发表了著名的《纽伦堡法典》，为医学人体实验制定了“一是必须有利于社会：二是应该符合伦理道德和法律”为主要内容的基本准则。第一个人体实验的伦理文献是《纽伦堡法典》（A对）。